在脏腑湿热证中，其共同特点是
A. 腹泻
B. 黄疸
C. 腹痛
D. 头胀重
E. 舌苔黄腻

正确答案：E。舌苔黄腻

解析：脏腑湿热时，湿浊内蕴，阳气被遏，湿浊停聚舌面而出现腻苔；热熏蒸于舌，故苔呈黄色（E对）。腹泻，多由感受外邪，如湿热、暑湿、寒湿之邪；情志所伤，忧思郁怒导致肝失疏泄，横逆犯脾而成泄泻；饮食不节，过食肥甘厚味，或进食不洁腐败之物（A错）。黄疸由于湿阻中焦，脾胃功能失常，影响肝胆的疏泄，以致胆汁不循常道，溢于肌肤，而发生黄疸（B错）。腹痛以脏腑气机不利，脏腑失养，经脉气血阻滞，不通则痛为基本病机（C错）。头目胀重，则多因肝火上炎或肝阳上亢，气血上壅所致（D错）。